女，65岁。因少尿诊断慢性肾功能不全，血生化检测：Na⁺136mmol/L，K⁺6.0mmol/L，Ca²⁺2.1mmol/L，HCO₃⁻25mmol/L，下列处理不正确的是
A. 使用氨苯蝶啶
B. 停用含钾药物
C. 静脉滴注葡萄糖+胰岛素
D. 静脉滴注葡萄糖酸钙
E. 静脉滴注碳酸氢钠溶液

正确答案：A。使用氨苯蝶啶

解析：患者高钾血症，禁用氨苯蝶啶（保K⁺利尿剂）（A错，为本题正确答案）。Na⁺136mmol/L（正常，正常值135-145mmol/L）。K⁺6.0mmol/L（高血钾，正常值3.5-5.5mmol/L）。Ca²⁺2.1mmol/L（低血钙，正常值2.25-2.58mmol/L）。静脉滴注葡萄糖+胰岛素可使K⁺向细胞内转移，改善高钾血症（C对），也应停用含钾药物（B对）。静脉滴注葡萄糖酸钙可补充血钙，对抗钾离子心肌毒性（D对）。静脉滴注碳酸氢钠溶液可增加血容量而稀释血清K⁺，又能促使K⁺移入细胞内或由尿排出。